能反映医学本质特征的是
A. 人才
B. 技术
C. 设备
D. 管理
E. 道德

正确答案：E。道德